水体酚的主要来源是
A. 工业废水
B. 生活污水
C. 农业污水
D. 炼焦废水
E. 炼油废水

正确答案：A。工业废水

解析：本题考查水体酚的主要来源。水体酚是一类有机污染物，主要来源于工业废水（A对BCDE错），是指含有多种有机物质的混合物，其中包括芳香族化合物、酚类、醛类、醇类、酮类、酯类、酶抑制剂等。